药材呈细长圆柱形，常弯曲或盘绕成团，质柔韧而实，味淡的是
A. 环草石斛
B. 耳环石斛
C. 黄草石斛
D. 马鞭石斛
E. 金钗石斛

正确答案：A。环草石斛